组织穿透力强的局麻药物是
A. 普鲁卡因
B. 布比卡因
C. 利多卡因
D. 阿替卡因
E. 丁卡因

正确答案：E。丁卡因

解析：本题考查局麻药。组织穿透力强的局麻药物是丁卡因（E对）。丁卡因丁卡因起效时间1～3min，易溶于水，对黏膜穿透力强，麻醉效力高，但毒性也大。临床上主要用于表面麻醉。普鲁卡因（A错）显效时间为2～5min。布比卡因（B错）显效时间是5～7min。利多卡因（C错）的组织穿透能力较阿替卡因差。阿替卡因显效时间为4min（D错），组织渗透性极强，与题干不符。